男性，40岁。胸痛、反酸、胃灼热、嗳气2个月，胃镜检查食管黏膜未见明显异常，最有助于明确诊断的检查是
A. 上消化道气钡双重造影
B. 13C尿素呼气试验
C. 24h胃食管pH监测
D. 腹部B超
E. 24h心电监测

正确答案：C。24h胃食管pH监测

解析：患者有胸痛、反酸、胃灼热、嗳气，胃镜检查食管黏膜无明显异常，考虑胃食管反流病。24小时食管pH监测（C对）是除了胃镜以外诊断胃食管反流病的重要诊断方法。上消化道气钡双重造影（A错）是诊断胃癌非常重要的诊断方法，可与胃镜检查互相补充。钡餐检查在确定病变的范围、大小，病变与全胃的关系，以及外界肿物对胃壁的压迫等方面具有独到的优点。但不适用于胃食管反流病。13C尿素呼气试验（B错）适用于幽门螺杆菌感染，消化道溃疡患者。腹部B超（D错）主要用于观察胃的邻近脏器（特别是肝、胰）受浸润及淋巴结转移的情况，不能用来确诊。24h心电监测（E错）是一种长时间连续记录并编集分析人体心脏在活动和安静状态下心电图变化状况，同样不能用来确诊胃食管反流病。